麝香粉末显微鉴别不得检出
A. 香囊内层皮膜组织
B. 圆形油滴
C. 方形、柱形或八面体形的晶体
D. 淀粉粒
E. 无定形颗粒状物集成的半透明或透明团块

正确答案：D。淀粉粒

解析：本题考查的是麝香的显微鉴别。麝香粉末显微鉴别不得检出淀粉粒（D错，为本题正确答案）。麝香【显微鉴别】麝香仁粉末棕褐色或黄棕色。呈淡黄色或淡棕色团块，由不定形颗粒状物集成，半透明或透明（E对）。团块中包埋或散在有方形、柱形、八面体或不规则的晶体（C对）。并可见圆形油滴（B对），偶见毛及脱落的内层皮膜组织（A对），无色或淡黄色，半透明，有纵皱纹，有时附油滴及结晶。